夏枯草的功效是
A. 解热毒
B. 清肝火
C. 降血压
D. 升清阳
E. 散郁结

正确答案：B、C、E。清肝火；降血压；散郁结

解析：本题考查的是夏枯草的功效。夏枯草的功效是清肝火（B对）、降血压（C对）与散郁结（E对）。夏枯草：【功效】清肝明目，散结消肿。夏枯草苦、寒，归肝、胆经，功善清泄肝胆之火、降血压，治肝火头痛、眩晕、目赤肿痛，以及高血压属肝火或肝阳上亢者。升麻：【功效】发表透疹，清热解毒（A错），升举阳气（D错）。